有关复方乙酰水杨酸片的不正确表述是
A. 加入1%的酒石酸可以有效地减少乙酰水杨酸的水解
B. 三种主药混合制粒及干燥时易产生低共熔现象，所以采用分别制粒法
C. 应采用尼龙筛制粒，以防乙酰水杨酸的分解
D. 应采用5%的淀粉浆作为黏合剂
E. 应采用滑石粉作为润滑剂

正确答案：A。加入1%的酒石酸可以有效地减少乙酰水杨酸的水解